克罗恩病的主要手术指征是
A. 持续性粪隐血阳性
B. 严重腹泻
C. 营养不良，体重减轻
D. 疑有恶变
E. 合并结肠息肉

正确答案：D。疑有恶变

解析：本病手术治疗后，复发率可达50%以上，故手术适应症主要是针对并发症，五个选项中只有疑似有恶变是后果较为严重的，故应当手术（D对）。持续性粪便隐血阳性不属于不能控制的大出血（A错）。腹泻（B错），营养不良，体重减轻（C错），合并结肠息肉（E错）症状较轻，由于术后复发率较高，应当进行保守治疗。